属于濒临灭绝状态的稀有珍贵野生药材是
A. 羚羊角
B. 石斛
C. 蛤蚧
D. 蟾酥
E. 斑蝥

正确答案：A。羚羊角

解析：本题考查野生药材物种。属于濒临灭绝状态的稀有珍贵野生药材是羚羊角（A对）。一级保护野生药材物种系指濒临灭绝状态的稀有珍贵野生药材物种。一级保护野生药材物种包括：虎骨、豹骨、羚羊角、鹿茸（梅花鹿）。二级保护野生药材物种系指分布区域缩小，资源处于衰竭状态的重要野生药材物种。蛤蚧（C错）、蟾酥（D错）属于二级保护野生药材物种。三级保护野生药材物种系指资源严重减少的主要常用野生药材物种。石斛（B错）属于三级保护野生药材物种。斑蝥（E错）为毒性药品中药品种。